执业药师承接患者咨询的内容主要有
A. 用药方法
B. 用药剂量
C. 药品不良反应
D. 药品相互作用
E. 汤剂煎煮方法

正确答案：A、B、C、D、E。用药方法；用药剂量；药品不良反应；药品相互作用；汤剂煎煮方法

解析：本题考查的是患者用药咨询。执业药师承接患者咨询的内容主要有用药方法（A对）、用药剂量（B对）、药品不良反应（C对）与药物相互作用（D对）。患者咨询的内容一般可分为：（1）药品名称。（2）适应病证。（3）用药禁忌。（4）用药方法。（5）用药剂量。（6）服药后预计疗效及起效时间、维持时间。（7）药品的不良反应与药物相互作用。（8）有否替代药物或其他疗法。（9）药品的鉴定辨识、贮存和有效期。（10）药品价格、报销，是否进入医疗保险报销目录等。汤剂煎煮方法（E错）不在患者用药咨询中。